以下关于人体测量尺寸的正确说法是
A. 与作业场所设计有关
B. 与作业场所设计无关
C. 与机器设计有关
D. 与机器设计无关
E. 与作业场所设计和机器设计有关

正确答案：E。与作业场所设计和机器设计有关